把健康、疾病与人类生活的自然环境与社会环境联系起来观察与思考，产生了朴素、辩证、整体的医学观念，指的是哪种医学模式
A. 神灵主义医学模式
B. 自然哲学的医学模式
C. 机械论的医学模式
D. 生物医学模式
E. 生物-心理-社会医学模式

正确答案：B。自然哲学的医学模式